大承气汤和调胃承气汤的共同组成药物有
A. 大黄、芒硝、甘草
B. 大黄、芒硝
C. 大黄、芒硝、枳实
D. 厚朴、芒硝、甘草
E. 枳实、芒硝、甘草

正确答案：B。大黄、芒硝

解析：大承气汤的药物组成为大黄、枳实、厚朴、芒硝，调胃承气汤的药物组成为大黄、芒硝、甘草，两者共同组成药物有大黄、芒硝（大承气汤用芒硝，大黄枳实厚朴饶，去硝名曰小承气，调胃承气硝黄草）（B对）。